男性，50岁。咳嗽，咳白色泡沫痰10年，每年持续4个月。近3年出现活动后气短，时有哮端。体检：两肺叩诊高清音，呼吸音低，呼气延长。患者应诊断为
A. 单纯型慢性支气管炎
B. 支气管哮喘、肺气肿
C. 喘息型慢性支气管炎
D. 喘息型慢性支气管炎、肺气肿
E. 单纯型慢性支气管炎、肺气肿

正确答案：D。喘息型慢性支气管炎、肺气肿